鹿茸药材中的“莲花”指的是
A. 一个侧枝的马鹿茸
B. 三个侧枝的马鹿茸
C. 二个侧枝的马鹿茸
D. 二个侧枝的花鹿茸
E. 三个侧枝的花鹿茸

正确答案：C。二个侧枝的马鹿茸

解析：本题考查的是马鹿茸药材的性状特征。鹿茸药材中的“莲花”指的是二个侧枝的马鹿茸（C对）。马鹿茸：：【性状鉴别】分枝较多，侧枝1个者（A错）习称“单门”，2个者习称“莲花”，3个者（B错）习称“三岔”，4个者习称“四岔”，或更多。花鹿茸：：【性状鉴别】具1个分枝者称“二杠”，两个者（D错）称“三岔”。三个侧枝的花鹿茸（E错），2022年考试指南未明确说明，花鹿茸的药材的来源不包括三个侧枝的花鹿茸。